温度刺激出现疼痛，但刺激去除后疼痛很快消失，可能为
A. 牙髓正常
B. 牙髓坏死
C. 可复性牙髓炎
D. 牙髓钙化
E. 慢性牙髓炎

正确答案：C。可复性牙髓炎

解析：可复性牙髓炎自觉症状：受到温度刺激尤其是冷刺激时，产生短暂、尖锐的疼痛，当刺激除去后，疼痛很快消失或仅延续数秒钟。掌握“可复性、急慢性牙髓炎”知识点。